正常妊娠38周时的羊水量约为
A. 600ml
B. 800ml
C. 1000ml
D. 1200ml
E. 1500ml

正确答案：C。1000ml

解析：正常妊娠8周时羊水量5～10ml，妊娠10周时羊水量约30ml，妊娠20周时羊水量约400ml，妊娠38周羊水量约1000ml（C对），此后羊水量减少，妊娠40周时羊水量约800ml（B错）（八年制妇产科学第二版P41）。